通过非共价键使亚基聚合形成具有
A. 一级结构的蛋白质
B. 二级结构的蛋白质
C. 三级结构的蛋白质
D. 四级结构的蛋白质
E. 五级结构的蛋白质

正确答案：D。四级结构的蛋白质

解析：蛋白质空间结构修饰：通过非共价键使亚基聚合，而形成具有四级结构的蛋白质。此外，蛋白质与辅基连接后，形成完整的结合蛋白质。掌握“蛋白质的生物合成”知识点。